心肌缺血时，牵涉痛通常发生在
A. 心前区、左肩和左上臂
B. 左上腹和肩胛间
C. 左肩胛和右肩胛
D. 上腹部和脐周围区
E. 下腹部和腹股沟区

正确答案：A。心前区、左肩和左上臂

解析：心肌缺血时，常感到心前区、左肩和左上臂疼痛（A对），为牵涉痛发生的部位。左上腹和肩胛间（B错）为患胃溃疡和胰腺炎时产生的牵涉痛。上腹部和脐周围区（D错）为阑尾炎产生的牵涉痛。